对乙型肝炎病毒有免疫力的指标是
A. HBsAg阳性
B. 抗-HBs阳性
C. 抗HBc阳性
D. 抗-HBe阳性
E. HBeAg阳性

正确答案：B。抗-HBs阳性

解析：抗-HBs是种保护性抗体，可阻止HBV穿过细胞膜进入新的肝细胞。抗-HBs阳性（B对）提示机体对乙肝病毒有一定程度的免疫力，注射过乙型肝炎疫苗或抗-HBs免疫球蛋白者，抗-HBs可呈现阳性反应。HBsAg本身不具传染性，但其常与HBV同时存在，故HBsAg阳性（A错）常被作为传染性标志之一。抗HBc阳性（C错）可作为HBsAg阴性的HBV感染的敏感指标，抗-HBcIgM阳性提示急性期或慢性肝炎急性发作。抗-HBe阳性（D错）表示大部分乙肝病毒被消除，复制减少，传染性降低。HBeAg阳性（E错）表示肝细胞损害较重，且可转为慢性乙型肝炎或肝硬化。